在温和酸水解的条件下，可水解的糖苷键是
A. 强心苷元-α-去氧糖
B. α-羟基糖（1—4）- 6-去氧糖
C. 强心苷元-α-羟基糖
D. α-羟基糖（1—4）-α-羟基糖
E. 强心苷元-P-葡萄糖

正确答案：A。强心苷元-α-去氧糖